问卷设计中常见错误有
A. 双重装填（指一个问题包括了2个或2个以上的问题）
B. 使用了一些专业术语
C. 诱导性提问和抽象的提问
D. 直接询问敏感性问题
E. 以上都是

正确答案：E。以上都是